下颌牙牙周膜面积大小顺序
A. 67835421
B. 67843521
C. 67854321
D. 76834521
E. 76843521

正确答案：A。67835421

解析：本题考查牙周膜面积。下颌牙牙周膜面积大小顺序是67835421（A对）。上颌牙牙周膜面积大小顺序是67384512，下颌是67835421。